正确描述腓总神经的是
A. 沿腘窝正中垂直下降
B. 绕过腓头上外方
C. 绕过腓骨头下外方
D. 只分布到腿外侧肌群
E. 只分布到腿后肌群

正确答案：C。绕过腓骨头下外方

解析：腓总神经在腘窝近侧端由坐骨神经发出后，沿构成腘窝上外侧界的股二头肌肌腱内侧向外下走行（A错），至小腿上段外侧绕腓骨颈向前穿过腓骨长肌（B错C对）。腓总神经的分布范围主要包括小腿前、外侧群肌和足背肌以及小腿外侧、足背和趾背的皮肤（DE错）。